脾胃在生理功能上相互关联，可概括为
A. 纳运配合
B. 燥湿相济
C. 以膜相连
D. 藏泄相和
E. 升降相因

正确答案：A、B、E。纳运配合；燥湿相济；升降相因

解析：本题考查的是脾与胃的关系。脾胃在生理功能上相互关联，可概括为纳运配合（A对）、燥湿相济（B对）与升降相因（E对）。脾与胃通过经脉相互络属而构成表里关系。脾与胃的相互配合，主要体现在三个方面：1.纳运协调：脾主运化，胃主受纳，一纳一运，相互协调配合，共同完成饮食物的消化吸收及其精微的输布，以营养全身。2.升降相因：脾气主升，胃气主降，一升一降，相互协调。3.燥湿相济。藏泄相和（D错）为肝与肾的关系。肝与肾的关系，称“肝肾同源”或“乙癸同源”（以天干配五行，肝属乙木，肾属癸水，故称），主要表现于精血同源、藏泄互用及阴阳互资等方面。以膜相连（C错）的脏腑，2022年考试指南未明确说明。